以下有关玻璃离子体的论述中，正确的是
A. 又称玻璃离子粘固剂
B. 又称玻璃离子水门汀
C. 玻璃离子体可释放氟离子
D. 光固化型玻璃离子体具有化学固化和光固化双重固化机制
E. 以上说法均正确

正确答案：E。以上说法均正确

解析：玻璃离子体又称玻璃离子粘固剂或玻璃离子水门汀（GIC），可用于修复体的粘接固位、衬洞、垫底、暂封和直接充填修复。光固化型玻璃离子体具有化学固化和光固化双重固化机制。玻璃离子体的优点是具有良好的粘接性、生物相容性、释放氟离子和耐溶解性。掌握“口腔材料的性能与选择、垫底与暂封材料”知识点。